下面关于臂丛的说法何者正确
A. 第5--8颈神经前支和第1胸神经前支的一部分组成
B. 发出膈神经
C. 经斜角肌间隙、锁骨前方到腋窝
D. 发出的正中神经仅分布到手掌和手指皮肤
E. 发出的尺神经分布上臂部分屈肌

正确答案：A。第5--8颈神经前支和第1胸神经前支的一部分组成

解析：臂丛由第5-8颈神经前支和第1胸神经前支的大部分纤维交织汇集而成（A对）。该神经丛的主要结构先经斜角肌间隙向外侧穿出，继而在锁骨后方行向外下进入腋窝（C错）。颈丛发出膈神经（B错）。发出的正中神经支配除肱桡肌、尺侧腕屈肌和指深屈肌尺侧半以外的所有前臂屈肌和旋前肌（D错）。发出尺神经在前臂上部发肌支支配尺侧腕屈肌和指深屈肌尺侧半（E错）。